患者，女，6岁，因发热、咳嗽2天就诊，以“肺部感染”收治入院。经验性抗感染治疗3天后，病原体培养+体外药敏试验结果显示嗜肺军团菌感染。首选的目标性抗感染药物是
A. 阿奇霉素
B. 克林霉素
C. 莫西沙星
D. 依替米星
E. 阿莫西林

正确答案：A。阿奇霉素

解析：本题考查社区获得性肺炎常见病原体目标治疗。嗜肺军团菌感染可首选左氧氟沙星500～750mg iv/po qd、莫西沙星（C错）400mg iv/po qd、阿奇霉素（A对）500mg iv qd、克拉霉素500mg po q12h治疗。该患者年龄属于未成年，禁止使用喹诺酮类药物。